下列都不易被致龋菌代谢产酸的是
A. 蔗糖、葡萄糖
B. 蔗糖、麦芽糖
C. 淀粉、山梨糖
D. 糊精、果糖
E. 果糖、木糖醇

正确答案：C。淀粉、山梨糖

解析：本题考查龋病发生的食物因素-碳水化合物。下列都不易被致龋菌代谢产酸的是淀粉、山梨糖（C对）。木糖醇、山梨醇能抑制致龋菌生长、产酸、积聚和抑制生物膜生长；淀粉（糊精）是多糖，一般不容易被致龋菌代谢产酸。蔗糖、葡萄糖（A错）、麦芽糖（B错）、果糖（DE错）和乳糖等，能被口腔细菌利用合成细胞壁多糖、荚膜多糖，胞内多糖以及有机酸。